奎尼丁最严重的不良反应是
A. 金鸡纳反应
B. 药热，血小板减少
C. 晕厥
D. 胃肠道反应
E. 心室率加快

正确答案：C。晕厥